α-酮酸可转变生成的物质是
A. CO₂和H₂O
B. 营养必须脂肪酸
C. 维生素A
D. 营养必须氨基酸
E. 维生素E

正确答案：A。CO₂和H₂O

解析：α-酮酸在体内可通过柠檬酸循环与生物氧化体系彻底氧化生成CO₂和H₂O（A对），同时释放能量以供机体生理活动需要。α-酮酸经氨基化可生成营养非必需氨基酸而不是营养必需氨基酸（D错）和营养必需脂肪酸（B错）。α-酮酸可转变成糖和脂类化合物，但不能转变成维生素A（C错）和维生素E（E错）。